女，35岁，G₆P₁。月经量增多3年，经期及周期正常。妇科检查：子宫前位，饱满，活动差，无压痛。推荐该患者最佳的避孕方法是
A. 惰性宫内节育器
B. 避孕套
C. 体外排精
D. 紧急避孕药
E. 短效口服避孕药

正确答案：B。避孕套

解析：中年女性患者，G₆P₁。月经量增多3年，经期及周期正常。妇科检查：子宫前位，饱满，活动差，无压痛。推荐该患者最佳的避孕方法是避孕套（B对），既能避孕，又能防止性传播疾病。惰性宫内节育器（A错）由于脱落率及带器妊娠率高，1993年已停止生产。体外排精（C错）避孕效果较差。紧急避孕药（D错）仅对一次无保护性生活有效，避孕有效率明显低于常规避孕方法，且紧急避孕药激素剂大副作用亦大，不能替代常规避孕。短效口服避孕药（E错）抑制排卵，不适用该患者。